下列哪种氨基酸必须由食物提供
A. 丙氨酸
B. 天门冬氨酸
C. 谷氨酸
D. 蛋氨酸
E. 丝氨酸

正确答案：D。蛋氨酸